小儿极重度贫血的诊断指标是
A. Hb＞120g/L
B. Hb120～90g/L
C. Hb90～60g/L
D. Hb60～30g/L
E. Hb＜30g/L

正确答案：E。Hb＜30g/L

解析：Hb＞120g/L属于正常血红蛋白范围（A错），小儿贫血根据血红蛋白含量可分为四度：1、血红蛋白从正常下限Hb120～90g/L者为轻度（B错）；2. Hb90～60g/L者为中度（C错）；3. Hb60～30g/L者为重度（D错）；4. Hb＜30g/L者为极重度（E对）。